紫外线对DNA的损伤主要是引起
A. 磷酸二酯键断裂
B. 嘧啶二聚体形成
C. 碱基插入
D. 碱基缺失
E. 碱基置换

正确答案：B。嘧啶二聚体形成